女性，30岁。半小时前家人发现其神志不清。既往无特殊病史。检查发现呕吐物有大蒜味，双侧瞳孔明显缩小。应首先考虑的是
A. 有机磷农药中毒
B. 阿托品中毒
C. 糖尿病酮症酸中毒
D. 尿毒症
E. 肝昏迷

正确答案：A。有机磷农药中毒

解析：青年女性患者，半小时前被发现神志不清，呕吐物有大蒜味（有机磷中毒的典型症状），双侧瞳孔明显缩小（有机磷中毒引起副交感神经过度兴奋），应首先考虑的是有机磷农药中毒（A对）。阿托品中毒（P877）（B错）主要表现为口干、皮肤干燥潮红、瞳孔散大、心动过速、发热等。糖尿病酮症酸中毒（P753）（C错）好发于糖尿病患者，主要表现为呼吸深快，呼气中有烂苹果味，后期严重失水，可出现眼眶下凹、皮肤黏膜干燥等。尿毒症（P527）（D错）的患者既往有肾脏病史，检查可发现口腔有尿味。肝昏迷（P435）（E错）常发生于肝硬化患者，常见扑翼样震颤、肌张力增高以及腱反射亢进等，检查可闻及氨臭味。